既祛风通络，又能凉血消肿的是
A. 香加皮
B. 海风藤
C. 络石藤
D. 木瓜
E. 蕲蛇

正确答案：C。络石藤

解析：本题考查的是络石藤的功效。既祛风通络，又能凉血消肿的是络石藤（C对）。络石藤：【功效】祛风通络，凉血消肿。香加皮（A错）：【功效】祛风湿，强筋骨，利水消肿。【主治病证】（1）风寒湿痹，腰膝酸软。（2）水肿（尤宜心衰性水肿），小便不利。海风藤（B错）：【功效】祛风湿，通经络。木瓜（D错）：【功效】舒筋活络，化湿和中，生津开胃。蕲蛇（E错）：【功效】祛风通络，定惊止痉。